女性卵巢功能成熟，生育能力旺盛的时期是
A. 幼年期
B. 青春期
C. 性成熟期
D. 更年期
E. 老年期

正确答案：C。性成熟期

解析：性成熟期是卵巢生殖功能与内分泌功能最旺盛时期。18岁开始，历时约30年，此期卵巢功能成熟，出现周期性排卵。生殖器官各部及乳房，在卵巢分泌的性激素作用下发生周期性变化。掌握“女性生殖系统生理”知识点。